女，26岁，初产妇。妊娠38周，规律腹痛8小时，胎膜破裂。骨盆外测量正常，枕左前位，胎心率146次/分，宫口开大6cm，S=+1。该产妇的产程进展最可能是
A. 产程进展正常
B. 羊膜腔感染
C. 活跃期延长
D. 潜伏期延长
E. 胎头下降停滞

正确答案：A。产程进展正常

解析：初产妇，妊娠38周（足月产），规律腹痛8小时（出现规律宫缩），胎膜破裂，骨盆外测量正常，枕左前位，胎心率146次/分（正常值110～160次/分），宫口开大6cm（最大加速期），S=+1（胎头下降至坐骨棘平面下1cm），该产妇处于正常的第一产程，所以该产妇产程进展正常（A对）。产妇并没有感染的症状及体征，故羊膜腔感染（B错）不考虑。活跃期延长（P208）（C错）为活跃期超过8小时。潜伏期延长（P208）（D错）为潜伏期超过16小时；胎头下降停滞（P209）（E错）为减速期后胎头下降停止＞1小时。